肾性贫血最主要的原因是
A. 铁及叶酸摄人不足
B. 消化道失血
C. 血红蛋白合成障碍
D. 红细胞寿命缩短
E. 促红细胞生成素合成不足

正确答案：E。促红细胞生成素合成不足

解析：慢性肾衰竭的患者多数有轻、中度贫血，主要是由于肾间质细胞促红细胞生成素合成不足（E对），导致红细胞生成减少，故称为肾性贫血。铁摄入不足（A错）、消化道失血（B错）为缺铁性贫血（P541）的常见病因。叶酸摄入不足（A错）为巨幼细胞贫血（P544）常见的病因。血红蛋白合成障碍（C错）是缺铁性贫血、铁粒幼细胞性贫血、载铁蛋白缺乏性贫血等形成的机制。红细胞寿命缩短（D错）是溶血性贫血（P551）的主要原因。